去除白细胞和血小板肝炎病毒和抗A、B抗体的红细胞属于
A. 浓缩红细胞
B. 洗涤红细胞
C. 冰冻红细胞
D. LPRBC
E. 冷沉淀

正确答案：B。洗涤红细胞

解析：去除白细胞及血小板、肝炎病毒和抗A、B抗体的红细胞属于洗涤红细胞（B对）。浓缩红细胞（A错），顾名思义是指浓缩了的红细胞，每110～120ml浓缩红细胞中包含了200ml全血中的所有红细胞。冰冻红细胞（C错）不含血浆，有利于稀有血型的保存。LPRBC（D错）即去白细胞的红细胞，特点是去除了90%的白细胞。冷沉淀（E错）是血浆在4℃条件下融解时不融的沉淀物，主要包含纤维蛋白原、Ⅷ因子等。